通式为（RCOO-）nMn⁺的阴离子表面活性剂是
A. 硬脂酸钠
B. 苯扎溴铵
C. 卵磷脂
D. 聚乙烯醇
E. 聚山梨酯80

正确答案：A。硬脂酸钠

解析：本题考查表面活性剂。硬脂酸钠（A对）是通式为（RCOO-）nMn⁺的阴离子表面活性剂；高级脂肪酸盐系肥皂类，其通式为（RCOO-）nMn+，为阴离子表面活性剂。苯扎溴铵（B错）为阳离子表面活性剂。卵磷脂（C错）为两性离子表面活性剂。聚乙烯醇（D错）为高分子表面活性剂。聚山梨脂80（E错）为非离子表面活性剂。